下列关于女性生殖系统炎症的叙述，错误的是
A. 滴虫阴道炎患者其性配偶也应检查
B. 生殖器炎症常为需氧菌及厌氧菌混合感染
C. 衣原体支原体所致生殖器炎症属性传播疾病
D. 滴虫阴道炎治疗一疗程后复查阴性即为治愈
E. 外阴阴道念珠菌病久治不愈，应查血糖

正确答案：D。滴虫阴道炎治疗一疗程后复查阴性即为治愈

解析：阴道炎症可同时侵及尿道、尿道旁腺及前庭大腺，因此，治疗时需全身用药与局部用药相结合。又因其可通过性交传播，故性伴侣也应同时检查治疗（A对）。滴虫阴道炎症治疗易复发，故应多治疗几个疗程防止反复（D错，为本题正确答案）。外阴阴道念珠菌久病不愈，应积极寻找病因，积极治疗原发病，故应检查血糖，如血糖高，应积极治疗糖尿病（E对）。生殖器炎症常为需氧菌及厌氧菌混合感染，有多种细菌存在，菌群之间可形成生态平衡（B对）。性传播疾病病原体如淋病奈瑟菌及沙眼衣原体，主要感染子宫颈柱状上皮，可引起急性子宫颈炎（C对）。